铰链位称为
A. 牙尖交错位
B. 正中（牙合）位
C. 正中关系位
D. 下颌姿势位
E. 后退接触位

正确答案：E。后退接触位

解析：本题考查颌位。铰链位称为后退接触位（E对）。铰链运动过程中，髁突始终处于关节窝的生理最后位，RCP又称为髁突的铰链位。下颌从后退接触位（RCP）开始可以作单纯铰链开口和前伸、侧向运动，具有可重复性。测定垂直距离采用下颌姿势位（D错）。牙位是指牙尖交错位（A错）。正中关系亦称下颌后退位，指下颌不偏左、不偏右，适居正中，髁状突处于关节窝的后位，在适当的垂直距离时，下颌骨对上颌骨的位置关系。它是一个稳定而可重复性的位置，是一个功能性的后退边缘位。下颌依此为轴可作约20mm转动，又称为铰链位。在此范围内，上下牙齿发生接触（一般在磨牙区），称为正中关系（C错），亦称下颌后退接触位。